中药二级保护品种的保护期限为
A. 五年
B. 七年
C. 十年
D. 十五年
E. 二十年

正确答案：B。七年

解析：本题考查中药二级保护品种的保护期限。中药二级保护品种的保护期限为七年（B对）。中药二级保护品种在保护期满后可以延长保护期限，时间为7年，由生产企业在该品种保护期满前6个月，依据条例规定的程序申报。